属于国家一级保护野生药材物种的是
A. 梅花鹿
B. 甘草
C. 龙胆
D. 洋金花
E. 罂粟

正确答案：A。梅花鹿

解析：本题考查野生药材物种。属于国家一级保护野生药材物种的是梅花鹿（A对）。一级保护野生药材物种系指濒临灭绝状态的稀有珍贵野生药材物种。一级保护野生药材物种包括：虎骨、豹骨、羚羊角、鹿茸（梅花鹿）。甘草（B错）为二级保护野生药材物种；龙胆（C错）为三级保护野生药材物种；洋金花（D错）为毒性药品类中药材；罂粟（E错）为麻醉药品类中药材。